佐药是指处方中
A. 调和诸药的药
B. 助君药治兼证的药
C. 治疗主病的药
D. 治疗次要兼证的药
E. 引药直达病所的药

正确答案：B。助君药治兼证的药

解析：本题考查方剂的组方原则。佐药是指处方中助君药治兼证的药（B对）。佐药意义有三：一为佐助药，即协助君、臣药加强治疗作用，或直接治疗次要兼证的药物；二为佐制药，即用以消除或减缓君、臣药的毒性或烈性的药物；三为反佐药，即根据病情需要，使用与君药药性相反而又能在治疗中起相成作用的药物。佐药的药力小于臣药，一般用量较轻。使药意义有二：一是引经药，即引方中诸药直达病所的药物（E错）；二是调和药，即调和诸药的作用（A错），使其合力驱邪。使药的药力小于臣药，用量亦轻。君药：即对处方的主证或主病（C错）起主要治疗作用的药物。它体现了处方的主攻方向，其药力居方中之首，是方剂组成中不可缺少的药物。其用量也较臣、佐药大。臣药意义有二：一是辅助君药加强治疗主病和主证的药物；二是针对兼病或兼证起治疗作用（D错）的药物。它的药力小于君药。